属于易爆的危险品是
A. 高锰酸钾
B. 石油醚
C. 氯化钾
D. 氰化钾
E. 氢氧化钠

正确答案：A。高锰酸钾

解析：本题考查易爆危险品。高锰酸钾（A对）是一种强氧化剂，与某些有机物或易氧化物接触，易发生爆炸，属于易爆危险品。